下面关于肩关节的特点的说法何者错误
A. 关节囊薄而松弛
B. 头大盂小
C. 易从囊下壁脱位
D. 全身最灵活的关节
E. 没有关节的辅助结构

正确答案：E。没有关节的辅助结构

解析：关节的辅助结构有：韧带、关节盘和关节唇、滑膜襞和滑膜囊。肩关节内有关节唇（E错，为本题正确答案）——盂唇来加深关节窝，但仍仅能容纳1/4~1/3关节头，所以可以说是头大盂小（B对）。肩关节关节囊上壁前后壁均有韧带加强，唯有下壁薄弱，所以在遭受创伤后，肩关节易从关节囊下壁脱位（C对）。肩关节为全身最灵活的关节（D对），可作三轴运动，即冠状轴上的屈和伸，矢状轴上的收和展，垂直轴上旋内、旋外及环转运动。